集中式供水的卫生调查、监测和监督的内容不包括
A. 水源卫生调查
B. 水厂调查
C. 由于已多次清洗设备，不必检验水质
D. 水质监测
E. 取水、输水、蓄水、净化消毒和配水过程中的管理和执行情况

正确答案：C。由于已多次清洗设备，不必检验水质

解析：本题考查集中式供水的卫生调查、监测和监督的内容。集中式供水的卫生调查、监测和监督的内容包括：1.水源卫生调查（A对）；2.供水单位调查（B对）：包括取水、输水、蓄水、净化消毒和配水过程中的管理和执行情况（E对）等；3.水质监测（D对）；4.卫生监督。“由于已多次清洗设备”只是确保设备的运行时可靠的一种手段，而不是对水质的检测，也不是对水质的质量确认（C错，为本题正确答案）。